有关体循环与肺循环的说法，何者错误
A. 肺循环又叫小循环
B. 体循环又称大循环
C. 肺循环始于体循环之先
D. 体循环主要是进行物质交换
E. 体循环与肺循环通过心脏而沟通

正确答案：C。肺循环始于体循环之先

解析：肺循环又叫小循环（A对）。体循环又称大循环（B对）。体循环和肺循环同时进行（C错，为本题正确答案）。体循环主要是进行物质交换（D对）。体循环与肺循环通过心脏而沟通（E对）。